不附于肩胛骨的肌是
A. 胸大肌
B. 胸小肌
C. 斜方肌
D. 前锯肌
E. 大圆肌

正确答案：A。胸大肌

解析：胸大肌（A错，为本题正确答案）起于锁骨内侧2/3段、胸骨前面、第1～6肋软骨前面，止于肱骨大结界，与肩胛骨无关。胸小肌（B对）止于肩胛骨喙突，斜方肌（C对）止于肩胛冈，前锯肌（D对）止于肩胛骨内侧缘和下角，大圆肌（E对）起于肩胛骨下角背面，均附于肩胛骨。